在临床试验中，对照组使用安慰剂的作用在于
A. 保证样本的代表性
B. 保证两组之间的可比性
C. 可避免来自病人和医生两方面的偏倚
D. 消除病人的主观选择研究条件对结果的影响
E. 检验两组的可比性

正确答案：D。消除病人的主观选择研究条件对结果的影响

解析：本题考查安慰剂的作用。在临床试验中，对照组使用安慰剂的作用在于消除病人的主观选择研究条件对结果的影响（D对ABCE错）。